《内经》所说“味过于辛”，则
A. 肝气以津，脾气乃绝
B. 大骨气劳，短肌，心气抑
C. 脾气不濡，胃气乃厚
D. 心气喘满，色黑，肾气不衡
E. 筋脉沮弛，精神乃央

正确答案：E。筋脉沮弛，精神乃央

解析：《素问·生气通天论》说：“味过于酸，肝气以津，脾气乃绝（A错）；味过于咸，大骨气劳，短肌，心气抑（B错）；味过于甘，心气喘满，色黑，肾气不衡（D错）；味过于苦，脾气不濡，胃气乃厚（C错）；味过于辛，筋脉沮弛，精神乃央（E对）。”